开设孕妇学校一般全孕期共多少次
A. 3～4次
B. 2～3次
C. 4～5次
D. 3～5次
E. 5～6次

正确答案：A。3～4次

解析：本题考查健康教育与咨询。孕妇学校的讲座内容一般采用教科书或讲义、幻灯、电视、电影等，给孕妇系统讲授有关妊娠、分娩、产褥、新生儿等方面的必要知识，并解答孕妇提出的有关问题。一般将全孕期分成妊娠前期和妊娠后期两大部分，根据孕妇的不同妊娠时期来安排相应的讲授内容。一般全孕期共3～4次（A对BCDE错）。